18岁患者主诉刷牙出血数月，检查见牙不松动，牙龈红肿，牙周探诊深度≤3mm，牙石（++），探诊出血，最佳处理方案应是
A. 服用阿莫西林和甲硝唑
B. 口腔卫生宣教和龈上洁治术
C. 口腔卫生宣教、龈上洁治术、根面平整术
D. 服用牙周宁片、使用含漱剂
E. 进行牙龈切除术

正确答案：B。口腔卫生宣教和龈上洁治术

解析：根据题干所给出的病情可判断，该患者所患的疾病为慢性龈炎，对这样的患者进行口腔卫生指导和龈上洁治术，疾病就可治愈，不需要根面平整和手术治疗，也不需要全身药物治疗，单纯药物治疗而不清除局部刺激因素不能治愈牙龈炎。掌握“慢性龈炎”知识点。